湿度是影响药物质量的一个重要因素，不仅可引起药物的物理和化学变化，如含水量、外观形态、化学成分发生改变等，而且能影响微生物的繁殖及害虫的生长。一般中药炮制品的质量控制和贮藏要求应是
A. 绝对含水量应控制在7%～13%，贮存环境的相对湿度应控制在35%～75%
B. 绝对含水量应控制在9%～13%，贮存环境的相对湿度应控制在30%～70%
C. 绝对含水量应控制在7%～15%，贮存环境的相对湿度应控制在35%～75%
D. 绝对含水量应控制在9%～15%，贮存环境的相对湿度应控制在35%～70%
E. 绝对含水量应控制在8%～15%，贮存环境的相对湿度应控制在40%～70%

正确答案：A。绝对含水量应控制在7%～13%，贮存环境的相对湿度应控制在35%～75%

解析：本题考查的是环境因素对重要质量变异的影响。一般中药炮制品的质量控制和贮藏要求应是绝对含水量应控制在7%～13%，贮存环境的相对湿度应控制在35%～75%（A对）。湿度是指空气中含有水蒸气量的程度，也就是空气潮湿的程度。它是影响药物质量的一个极重要因素，不仅可引起药物的物理和化学变化，如含水量、外观形态、化学成分发生改变等，而且能影响微生物的繁殖及害虫的生长。一般炮制品的绝对含水量应控制在7%～13%，贮存环境的相对湿度应控制在35%～75%。当空气相对湿度达到75%，温度30℃，很多饮片会加速吸收空气中的水分，而使本身含水量增加，易发生霉变现象，特别是含糖类、黏液质、淀粉类饮片更容易吸潮变质，如天冬、地黄、山药等；一些粉末状药物也易吸潮粘连成块。相对湿度高于75%时，多数无机盐类矿物药都容易潮解，如芒硝、胆矾；盐炙的饮片也容易吸收空气中的水分而变潮，继而生霉，如盐知母等；有些蜜炙饮片，如炙甘草、炙黄芪、炙枇杷叶等，特别容易吸湿粘连，吸湿后饮片表面也容易霉变。但当相对湿度过低时，饮片的含水量又易逐渐降低，含结晶水的药物易失去结晶水而风化。